必须在醒目位置注明的包装是
A. 药品的内包装
B. 药品的外包装
C. 药品的最小销售单元的包装
D. 外用药品的包装
E. 对药品贮藏有特殊要求的包装

正确答案：E。对药品贮藏有特殊要求的包装